心的哪一部分提供体循环血流的动力
A. 左心房
B. 右心房
C. 左心室
D. 右心室
E. 无

正确答案：C。左心室

解析：左心房（A错）为肺循环的终止，血液经肺循环最后进入左心房。右心房（B错）为体循环的终止，血液经体循环最后进入右心房。左心室（C对）提供体循环血流的动力，将血液由左心室泵出。右心室（D错）提供肺循环血流的动力，将血液由右心室泵出。